塑料全冠一般不用于
A. 暂时修复体
B. 诊断性修复体
C. 修复前牙过小牙
D. 修复前牙切角缺损
E. 修复磨牙外形

正确答案：E。修复磨牙外形

解析：本题考查塑料全冠的应用。磨牙需承受的咬合力较大，塑料全冠不能满足其需求，故一般不能用于修复磨牙外形（E错，为本题的正确答案）。塑料全冠的特点是色泽、价廉、易制作、不耐磨、易老化变色，一般适用于全冠牙体预备后的暂时冠，作为暂时性修复体（A对），具有保护、维持与稳定、恢复功能、自洁等作用。塑料全冠作为诊断修复体（B对）时，可提供形态、位置、美学等一系列信息，有利于最终修复体达到最佳的牙冠形态、排列位置和美学效果。与金属全冠和烤瓷冠相比，塑料全冠的强度较低、硬度不足、脆性大、韧性小，各项力学性能均较差。前牙承担的咬合力小，若患者小心保护，还是可以用于修复前牙过小牙（C对）以及修复切角缺损（D对）的。